女，55岁，高血压史多年，诊断为药物性牙龈增生。该患者的治疗方案，哪一项不正确
A. 牙周基础治疗
B. 全身应用抗生素
C. 口腔卫生宣教
D. 最好换另一类降压药
E. 必要时，可作牙周手术

正确答案：B。全身应用抗生素

解析：本题考查药物性牙龈肥大的治疗。全身应用抗生素（B错，为本题的正确答案）主要应用于急性坏死性溃疡性龈炎、侵袭性牙周炎等炎症症状严重或伴有全身症状的情况，不用于药物性龈增生的治疗。患者为药物性龈增生，因有高血压病史，考虑药物性龈增生是由服用钙通道阻滞剂类的降压药引起，因此该患者的治疗主要包括：1.去除局部刺激因素；2.认真细致的牙周基础治疗（A对）；3.对牙周治疗后龈肥大状况改善不明显的患者应考虑换另一类降压药（D对）或与其他药物交替使用，以减轻副作用；3.局部药物治疗；4必要时，可作牙周手术治疗（E对）；5.口腔卫生宣教（C对），指导患者严格控制菌斑，以减轻服药期间的牙龈增生程度，减少和避免术后的复发。